男，30岁。排便次数增多、大便带血1个月。无腹痛、发热，无体重变化。查体：T36.7°C，P80次/分，R18次/分，BP120/80mmHg。浅表淋巴结未触及。双肺呼吸音清，未闻及干湿性啰音，心律齐。腹软，无压痛，肝脾肋下未触及。直肠指检：触及一个柔软光滑有蒂包块，直径约1cm，指套带血。最可能诊断是
A. 结肠癌
B. 直肠息肉
C. 血栓性外痔
D. 肛窦炎
E. 直肠癌

正确答案：B。直肠息肉

解析：青年男性患者，排便次数增多、大便带血，无腹痛、发热，无体重变化，查体未见明显异常，直肠指检：触及一个柔软光滑有蒂包块，直径约1cm，指套带血（直肠息肉的典型表现），最可能诊断是直肠息肉（B对），结肠癌（A错）虽也有粪便次数增多，大便带血的症状，但有腹痛、消瘦、乏力贫血的等症状，且直肠指检多正常。血栓性外痔（C错）表现为肛周暗紫色卵圆形肿物，表面皮肤水肿、质硬、急性期触痛压痛明显。肛窦炎（D错）常表现为排便不尽，肛门发涨，肛管下坠感，疼痛，肛门瘙痒。直肠癌（E错）在直肠指检时可触及高低不平的肿块。